气虚血滞肢体麻木宜用
A. 人参
B. 黄芪
C. 白术
D. 党参
E. 山药

正确答案：B。黄芪

解析：本题考查的是黄芪的主治病证。气虚血滞肢体麻木宜用黄芪（B对）。黄芪：【主治病证】（1）脾胃气虚，脾肺气虚，中气下陷，气不摄血，气虚发热。（2）自汗，盗汗。（3）气血不足所致的疮痈不溃或溃久不敛。（4）气虚水肿、小便不利。（5）气血双亏，血虚萎黄，血痹肢麻，半身不遂，消渴。人参（A错）：【主治病证】（1）气虚欲脱证。（2）脾气虚弱之食欲不振、呕吐泄泻。（3）肺气虚弱之气短喘促、脉虚自汗。（4）热病津伤之口渴，消渴证。（5）心神不安，失眠多梦，惊悸健忘。白术（C错）：【主治病证】（1）脾胃气虚之食少便溏、倦怠乏力。（2）脾虚水肿，痰饮。（3）表虚自汗。（4）脾虚气弱之胎动不安。党参（D错）：【主治病证】（1）脾气亏虚之食欲不振、呕吐泄泻。（2）肺气亏虚之气短喘促、脉虚自汗。（3）气津两伤之气短口渴。（4）血虚萎黄，头晕心慌。山药（E错）：【主治病证】（1）脾虚气弱之食少便溏或泄泻。（2）脾虚或肺肾两虚之喘咳。（3）肾阴虚证，消渴证。（4）肾虚遗精、尿频、带下。